制定《处方药与非处方药分类管理办法》的目的是
A. 使消费者有权自主选购药品
B. 实现2000年“人人享有初级卫生保健”
C. 规范非处方药新药的研制，加强新药的审批管理
D. 保障人民用药安全有效、使用方便
E. 规范药品广告审批、发布管理

正确答案：D。保障人民用药安全有效、使用方便